第四代粘接剂对牙本质的固位作用产生于
A. 微机械嵌合
B. 化合键
C. 螯合
D. 氢键
E. 范德华力

正确答案：A。微机械嵌合

解析：本题考查酸蚀-冲洗粘接技术。第四代粘接剂对牙本质的固位作用产生于微机械嵌合（A对）。第四代牙本质粘接系统是经典的全酸蚀粘接系统，现在改称为酸蚀-冲洗粘接系统。粘结剂对牙本质的粘结机制建立在粘结界面形成混合层和树脂突结构的基础上，混合层是粘结剂与牙本质间的杂化结构，其内既有牙本质的胶原纤维网状结构，又有渗入胶原纤维网内的粘结剂成分，这些结构是形成微机械嵌合的基础，也是决定粘结强度的主要因素。